用于治疗铅中毒的特殊解毒剂是
A. 氟马西尼
B. 青霉胺
C. 乙氟胺
D. 纳洛酮
E. 亚硝酸钠

正确答案：B。青霉胺

解析：本题考查中毒解救。青霉胺（B对）用于铜、汞、铅中毒的解毒，治疗肝豆状核变性病。氟马西尼（A错）用于苯二氮䓬类药物过量或中毒。乙氟胺（C错）（解氟灵）用于有机氟杀虫农药中毒。纳洛酮（D错）用于急性阿片类中毒及急性乙醇中毒。亚硝酸钠（E错）治疗氰化物中毒。